一项为期6年的小学生龋病变化情况的研究，计划每年对学生进行一次口腔健康检查。该研究方法属于
A. 现况调查
B. 群组研究
C. 常规资料分析
D. 纵向研究
E. 现场实验

正确答案：D。纵向研究

解析：本题虽然计划每年都对小学生进行口腔健康检查，用的都是现况调查的方法，但连续6年就是一项纵向研究，用于观察这些学生的龋病患病趋势。纵向研究又称“疾病监测”，即研究疾病或某种情况在一个人群中随着时间推移的自然动态变化。也就是对一组人群定期随访，两次或若干次横断面调查结果的分析。它的作用在于动态地观察疾病或某种现象的演变情况及其原因分析。掌握“口腔流行病学概述及研究方法”知识点。